目前临床根管充填常用的材料是
A. 银尖+ZOE糊剂
B. 牙胶尖+ZOE糊剂
C. ZOE糊剂
D. 牙胶尖+氢氧化钙糊剂
E. 氯仿+牙胶尖

正确答案：B。牙胶尖+ZOE糊剂

解析：本题考查根管充填材料。目前临床根管充填常用的材料是牙胶尖+ZOE糊剂（B对）。临床上行根管充填时，常使用的是牙胶尖+氧化锌丁香油（ZOE糊剂）。目前银尖（A错）已基本不用于临床。牙胶尖应用于口腔科已经100多年，是迄今为止使用最为普遍的充填材料。氧化锌丁香油类（ZOE糊剂）（DE错）是目前临床上使用最多的根管封闭剂。根管充填时，不能只使用氧化锌丁香油（ZOE糊剂）（C错），还应有牙胶尖作为主充填物。